区分流感病毒亚型的依据是
A. RNA+NA
B. DNA+HA
C. NA+NP
D. HA+NP
E. HA+NA

正确答案：E。HA+NA

解析：流感病毒包膜表面有两种病毒编码的糖蛋白刺突，一种称血凝素（HA），另一种称神经氨酸酶（NA），是划分流感病毒亚型的依据。掌握“正、副黏病毒”知识点。